表浅的黏膜下脓肿切开引流，拔除松动的乳牙或恒牙，最常用的局麻方法是
A. 涂布麻醉
B. 阻滞麻醉
C. 冷冻麻醉
D. 吸入麻醉
E. 低温麻醉

正确答案：A。涂布麻醉

解析：表面麻醉亦称涂布麻醉，适用于表浅的黏膜下脓肿切开引流，拔除松动的乳牙或恒牙，以及行气管内插管前的黏膜表面麻醉。掌握“颌面部常用局麻法及牙拔除的麻醉选择”知识点。